从经济和价值观念出发，在一定时期内一定价格水平上人们愿意而且有能力消费的卫生服务量是
A. 卫生服务需求
B. 卫生服务提供
C. 卫生服务需要
D. 卫生服务利用
E. 卫生服务购买

正确答案：A。卫生服务需求

解析：从经济和价值观念出发，在一定时期内和一定价格水平上，人们愿意而且有能力消费的卫生服务量是卫生服务需求（A对）。